副作用为小脑共济失调的药物是
A. 阿糖胞苷
B. 长春新碱
C. 泼尼松
D. 甲氨蝶呤
E. 柔红霉素

正确答案：A。阿糖胞苷

解析：阿糖胞苷可引起小脑共济失调（A对）。长春新碱（B错）的毒性反应主要骨髓抑制、神经毒性、消化道反应、脱发以及注射局部刺激等。泼尼松（C错）的不良反应有医源性肾上腺皮质功能亢进、诱发或加重感染、消化系统并发症、心血管并发症、糖尿病等。甲氨蝶呤（D错）的不良反应包括消化道反应、骨髓抑制，长期应用可致肝肾损害，妊娠早期可致畸胎、死胎。柔红霉素（E错）主要毒性反应为骨髓抑制、消化道反应和心脏毒性等。